上皮的棘层、基底层或固有层镜下可见Civatte小体的是
A. 白斑
B. 红斑
C. 天疱疮
D. 盘状红斑狼疮
E. 扁平苔藓

正确答案：E。扁平苔藓

解析：本题考查口腔扁平苔藓与慢性盘状红斑狼疮。扁平苔藓镜下见在上皮的棘层、基底层或固有层可见胶样小体或称Civatte小体（E对），呈圆形或卵圆形。